下列评价指标中属于远期效果评价指标的是
A. 卫生知识合格率
B. 卫生知识知晓率
C. 平均期望寿命
D. 行为改变率
E. 信念流行率

正确答案：C。平均期望寿命